比较几种疗效相同的干预方案所需成本应用药物经济学研究方法是
A. 最小成本法
B. 最大成本法
C. 成本效果分祈
D. 成本效益分析
E. 成本效用分析

正确答案：A。最小成本法

解析：本题考查最小成本法。最小成本分析法（A对）指对预防、诊治或干预的收益或结果相同的两个或两个以上的备选方案的成本进行比较，从中选出的一种分析成本最小的方案方法。